休克的最主要特征是
A. 心输出量降低
B. 动脉血压降低
C. 组织循环灌流量锐减
D. 外周阻力升高
E. 外周阻力降低

正确答案：C。组织循环灌流量锐减

解析：休克是指机体在严重失血失液、感染、创伤等强烈致病因子的作用下，有效循环血量急剧减少，组织循环灌流量锐减（C对ABDE错），引起细胞缺血、缺氧，以致各重要生命器官的功能、代谢障碍或结构损害的全身性危重病理过程。